神识不清，语言重复，时断时续，语声低弱，称为
A. 谵语
B. 郑声
C. 短气
D. 错语
E. 哮喘

正确答案：B。郑声

解析：郑声表现为神识不清，语言重复，时断时续，语声低弱模糊，多因久病脏气衰竭，心神散乱所致，属虚证，故《伤寒论》谓“虚则郑声”（B对）。谵语多表现为神识不清，语无伦次，声高有力，常由邪热内扰神明所致，属实证（A错）。短气多表现为呼吸气急短促，气短不足以息，数而不相接续，喉中没有痰鸣音（C错）。错语多表现为神识清楚而语言时有错乱，说后自知言错（D错）。哮，指呼吸急促似喘，喉间有哮鸣音，常反复发作，缠绵难愈。喘，指呼吸困难、短促急迫，甚至张口抬肩，鼻翼煽动，难以平卧（E错）。